支气管哮喘伴有尿路梗阻的病人应禁用的药物是
A. 阿托品
B. 东莨菪碱
C. 山莨菪碱
D. 后马托品
E. 新斯的明

正确答案：E。新斯的明

解析：新斯的明的不良反应：治疗量时副作用较小，过量时可引起“胆碱能危象”，产生恶心、呕吐、腹痛、心动过缓、肌肉震颤和肌无力加重等，甚至呼吸衰竭死亡。其中M样症状可用阿托品对抗。禁用于机械性肠梗阻、支气管哮喘、泌尿道阻塞等（E对）。